关于上腔静脉，以下哪个不正确
A. 位于上纵隔
B. 管壁薄且有静脉瓣
C. 由双侧头臂静脉汇合而成
D. 受纳奇静脉血液的注入
E. 注入右心房

正确答案：B。管壁薄且有静脉瓣

解析：上腔静脉位于上纵隔（A对）。管壁厚且无（B错，为本题正确答案）静脉瓣。由左、右头臂静脉汇合而成（C对）。受纳奇静脉血液的注入（D对）。注入右心房（E对）。